粉末中草酸钙簇晶甚多，含晶细胞连接，簇晶排列成行的药材是
A. 厚朴
B. 牡丹皮
C. 杜仲
D. 合欢皮
E. 白鲜皮

正确答案：B。牡丹皮

解析：本题考查的是牡丹皮药材的显微鉴别。粉末中草酸钙簇晶甚多，含晶细胞连接，簇晶排列成行的药材是牡丹皮（B对）。牡丹皮【显微鉴别】粉末：淡红棕色。①淀粉粒众多，单粒呈类球形或多角形，直径3～16㎛，脐点点状、裂缝状或飞鸟状；复粒由2～6粒复合而成。②草酸钙簇晶甚多，直径9～45㎛，有时含晶薄壁细胞排列成行；也有一个薄壁细胞中含有数个簇晶，或簇晶充塞于细胞间隙中者。③连丹皮可见木栓细胞长方形，壁稍厚，浅红色。厚朴（A错）：【性状鉴别】药材干皮呈卷筒状或双卷筒状，习称“筒朴”；近根部干皮一端展开如喇叭口，习称“靴筒朴”。外表面灰棕色或灰褐色，粗糙，有时呈鳞片状，较易剥落，有明显的椭圆形皮孔和纵皱纹；刮去粗皮者显黄棕色。内表面紫棕色或深紫褐色，较平滑，具细密纵纹，划之显油痕。质坚硬，不易折断，断面颗粒性，外层灰棕色，内层紫褐色或棕色，有油性，有的可见多数小亮星。气香，味辛辣、味苦。杜仲（C错）：【性状鉴别】药材呈板片状或两边稍向内卷，大小不一。外表面淡灰棕色或灰褐色，有明显的皱纹或纵裂槽纹，有的树皮较薄，未去粗皮，可见明显的斜方形皮孔，内表面暗紫色或紫褐色，光滑。质脆，易折断。断面有细密、银白色、富弹性的橡胶丝相连。气微，味稍苦。合欢皮（D错）：【性状鉴别】药材呈卷曲筒状或半筒状。外表面灰棕色至灰褐色，稍有纵皱纹，有的成浅裂纹，密生明显的椭圆形横向皮孔，棕色或棕红色，偶有突起的横棱或较大的圆形枝痕，常附有地衣斑；内表面淡黄棕色或黄白色，平滑，有细密纵纹。质硬而脆，易折断，断面呈纤维性片状，淡黄棕色或黄白色。气微香，味淡、微涩、稍刺舌，而后喉头有不适感。白鲜皮（E错）：【性状鉴别】药材呈卷筒状。外表面灰白色或淡灰黄色，具细纵皱纹及细根痕，常有突起的颗粒状小点；内表面类白色，有细纵纹。质脆，折断时有粉尘飞扬，断面不平坦，略呈层片状，剥去外层，迎光可见有闪烁的小亮点。有羊膻气，味微苦。